I₁大气质量指数的主要特点是
A. 能综合评价几种污染物
B. 考虑了每个分指数的平均值
C. 考虑了几个分指数中的最高值
D. 兼顾了平均分指数和最高分指数
E. 兼顾了最高平均分指数和超标分指数

正确答案：D。兼顾了平均分指数和最高分指数

解析：本题考查I₁大气质量指数的主要特点。I₁大气质量指数是兼顾最高分指数和平均分指数（D对ABCE错）的环境质量指数。